网膜囊位置在
A. 肝左下后间隙
B. 肝左上间隙
C. 肝右下间隙
D. 肝左下前间隙
E. 肝右上间隙

正确答案：A。肝左下后间隙

解析：肝左下后间隙（A对）就是网膜囊，肝左上间隙（B错）位于网膜囊的上方，肝右下间隙（C错）位于网膜囊的下右方，肝左下前间隙（D错）位于网膜囊的前下方，肝右上间隙（E错）位于网膜囊的右方。